除另有规定外，应照《中国药典》规定的方法检查相对密度的制剂是
A. 煎膏剂
B. 膏药
C. 软膏剂
D. 乳膏剂
E. 流浸膏剂

正确答案：A。煎膏剂

解析：本题考查的是煎膏剂的质量要求。除另有规定外，应照《中国药典》规定的方法检查相对密度的制剂是煎膏剂（A对）。煎膏剂：系指中药饮片用水煎煮，煎液浓缩，加炼蜜或炼糖（或转化糖）制成的半流体制剂，俗称膏滋。按照《中国药典》规定的方法检查，相对密度，不溶物、装量及微生物限度均应符合规定。膏药（B错）：系指饮片、食用植物油与红丹（铅丹）或官粉（铅粉）炼制成膏料，摊涂于裱褙材料上制成供皮肤贴敷的外用制剂。膏药软化点、重量差异等应符合《中国药典》规定。软膏剂（C错）：系指原料药物与油脂性或水溶性基质混合制成的均匀的半固体外用制剂。乳膏剂（D错）：系指原料药物溶解或分散于乳状液型基质中形成的均匀半固体制剂。软膏剂及乳膏剂应根据《中国药典》规定进行相关检查：①粒度：除另有规定外，混悬型软膏剂、含饮片细粉的软膏剂照《中国药典》粒度和粒度分布测定法测定，均不得检出大于180μm的粒子。②装量：照《中国药典》最低装量检查法检查，应符合规定。③无菌：用于烧伤（除程度较轻的烧伤，即Ⅰ度或浅Ⅱ度外）或严重创伤的软膏剂与乳膏剂，照《中国药典》无菌检查法检查，应符合规定。④微生物限度：除另有规定外，照《中国药典》非无菌产品微生物限度检查：微生物计数法和控制菌检查法及非无菌药品微生物限度标准检查，应符合规定。流浸膏剂（E错）：系指饮片用适宜的溶剂提取，蒸去部分或全部溶剂，调整至规定浓度而制成的制剂。按照《中国药典》规定的方法检查，流浸膏剂的装量、微生物限度应符合规定。含有乙醇的流浸膏剂的乙醇量、甲醇量应符合规定。